以下有关复合树脂的论述中，不恰当的是
A. 无机填料是决定复合树脂物理性能和临床应用的关键成分
B. 树脂基质是复合树脂的主要聚合成分
C. 最常用的树脂基质是丙烯酸酯类
D. 临床上每层充填和固化的材料厚度不超过2mm
E. 化学固化复合树脂为目前主流的复合树脂

正确答案：E。化学固化复合树脂为目前主流的复合树脂

解析：光固化复合树脂：为目前主流的复合树脂。树脂含光引发体系，包括光敏剂和促进剂。化学固化复合树脂：为早期产品。树脂为双组分剂型，分别含有氧化还原引发体系。将两组分调和后，氧化还原体系迅速产生自由基，引发聚合反应。化学固化复合树脂因操作时间不易控制，目前很少用于充填修复。掌握“口腔材料的性能与选择、垫底与暂封材料”知识点。